可减弱香豆素类药物抗凝血作用的药物是
A. 甲苯磺丁服
B. 奎尼丁
C. 阿司匹林
D. 苯巴比妥
E. 羟基保泰松

正确答案：D。苯巴比妥